下列各项，不属热伤冲任所致病证的是
A. 月经先期
B. 月经过多
C. 月经过少
D. 崩漏
E. 经行吐衄

正确答案：C。月经过少

解析：热扰冲任，血海不宁，迫血妄行，可致月经先期、月经过多、崩漏、胎漏、胎动不安、产后恶露不绝，经行吐衄等（C错，为本题正确答案）。